脂肪酸β-氧化和酮体生成共同的中间产物是
A. 甲基二羟戊酸
B. HMGCoA
C. β-羟丁酸
D. 乙酰乙酰CoA
E. 乙酰乙酸

正确答案：D。乙酰乙酰CoA

解析：本题考查脂肪酸β-氧化和酮体生成共同的中间产物。脂肪酸β-氧化和酮体生成共同的中间产物是乙酰乙酰CoA （D对）。